牙龈的组织学特征是
A. 没有角化层
B. 血管丰富
C. 无黏膜下层
D. 缺乏颗粒层
E. 固有层为疏松结缔组织

正确答案：C。无黏膜下层

解析：本题考查牙龈的组织学特点。牙龈的组织学特征是无黏膜下层（C对）。牙龈的组织学特点：1.牙龈是口腔黏膜的一部分，由上皮层和固有层组成，无黏膜下层；其中上皮又分为牙龈上皮、龈沟上皮和结合上皮，牙龈上皮有角化（A错）；固有层由致密的结缔组织构成（E错），含有丰富的胶原纤维。2.牙龈的血管来自牙槽动脉分支（B错），即：①分布在牙槽骨颊舌侧的骨膜上动脉；②牙周膜的血管分支进入牙龈；③牙槽中隔动脉。3.牙龈含丰富的淋巴管，起自牙龈固有层中的乳头层，汇合成牙槽骨骨膜淋巴网，回流到颏下和下颌下淋巴结中。4.牙龈有丰富的神经，在上颌来自上牙槽和腭前神经，在下颌来自下牙槽神经和舌神经。有不同类型的神经末梢，如触觉小体、环状和球状小体，或很细的神经纤维进人上皮层中。